我国《生活饮用水卫生监督管理办法》规定，下列哪项涉水产品不须经国务院卫生计生主管部门审批，但须经省级人民政府卫生计生主管部门审批后方准投入生产、销售、使用
A. 与饮用水接触的防护涂料
B. 水质处理器
C. 与饮用水接触的新材料和化学物质
D. 涉及饮用水卫生安全的各类进口产品
E. 水处理剂

正确答案：E。水处理剂

解析：本题考查须经省级人民政府卫生计生主管部门审批后方准投入生产、销售、使用的涉水产品。《生活饮用水卫生监督管理办法》规定：“涉及饮用水卫生安全的产品，必须进行卫生安全性评价。”其中由国家卫生计生委审批的产品：①与饮用水接触的防护涂料（A错）；②水质处理器（B错）；③与饮用水接触的新材料和化学物质（C错）；④涉及饮用水卫生安全的各类进口产品（D错）。由省级卫生计生部门审批的产品：①与饮用水接触的连接止水材料、塑料及有机合成管材、管件，各类饮水机；②水处理剂（E对）；③除垢剂。未经审批的不得生产、销售和使用。